大剂量静脉注射可引起心率减慢的是
A. 肾上腺素
B. 去甲肾上腺素
C. 异丙肾上腺素
D. 多巴胺
E. 间羟胺

正确答案：B。去甲肾上腺素

解析：去甲肾上腺素（B对）对α受体具有强大的激动作用，血管收缩，小剂量由于心脏兴奋收缩压升高，大剂量时血管收缩明显，外周阻力增高，收缩压和舒张压均升高，反射性兴奋迷走神经，可使心率减慢。肾上腺素（A错）作用于心肌、传导系统和窦房结的β₁、β₂受体，加强心肌收缩力，加速传导，加速心率，增加心输出量等。异丙肾上腺素（C错）为经典的人工合成的β₁、β₂受体激动剂，对β₁受体具有强大的激动作用，表现为正性肌力和正性频率作用，与肾上腺素相比，加快心率以及加速传导的作用更强。多巴胺（D错）一般剂量对心率影响不大，大剂量可激动心脏β₁受体，加快心率。间羟胺（E错）直接兴奋血管α受体，使血管收缩，血压升高，由于升压作用持久，收缩作用叫平缓，较少引起心率变化。